公共场所经营者应当按照卫生标准、规范的要求对公共场所的空气、微小气候、水质、采光、照明噪声、顾客用品用具等进行卫生检测，检测每年
A. 不得少于三次
B. 不得少于四次
C. 不得少于一次
D. 不得少于两次
E. 不得少于五次

正确答案：C。不得少于一次

解析：本题考查公共场所定期开展卫生检测的频次。公共场所经营者应当按照卫生标准、规范的要求对公共场所的空气、微小气候、水质、采光、照明、噪声、顾客用品用具等进行卫生检测，检测每年不得少于一次（C对ABDE错）。检测结果不符合卫生标准、规范要求的应当及时整改。